某男，34岁。患湿浊内蕴、胆经郁火所致的鼻塞、流浊涕、前额头痛。宜选用的中成药是
A. 鼻渊舒胶囊
B. 辛芩颗粒
C. 鼻炎康片
D. 千柏鼻炎片
E. 藿胆丸

正确答案：E。藿胆丸

解析：本题考查霍胆丸的主治。宜选用的中成药是霍胆丸（E对）。霍胆丸（片）【主治】湿浊内蕴、胆经郁火所致的鼻塞、流清涕或浊涕、前额头痛。鼻渊舒胶囊（A错）（口服液）【主治】鼻炎、鼻窦炎属肺经风热及胆腑郁热证者。辛芩颗粒（B错）【主治】肺气不足、风邪外袭所致的鼻痒、喷嚏、流清涕、易感冒；过敏性鼻炎见上述证候者。鼻炎康片（C错）【主治】风邪蕴肺所致的急、慢性鼻炎，过敏性鼻炎。千柏鼻炎片（D错）【主治】风热犯肺、内郁化火、凝滞气血所致的鼻塞、鼻痒气热、流涕黄稠，或持续鼻塞、嗅觉迟钝；急慢性鼻炎、急慢性鼻窦炎见上述证候者。